肾柱
A. 位于肾皮质内
B. 呈锥体状
C. 肾髓质的一部分
D. 皮质伸入髓质的部分
E. 髓质伸入皮质的部分

正确答案：D。皮质伸入髓质的部分

解析：肾柱为伸入肾锥体之间的肾皮质（D对）。